清气化痰丸主治
A. 湿痰犯肺咳嗽
B. 痰热内结咳嗽
C. 肺燥有痰咳嗽
D. 寒痰内蕴咳嗽
E. 风邪犯肺咳嗽

正确答案：B。痰热内结咳嗽

解析：清气化痰丸的功用为清热化痰，理气止咳，主治痰热咳嗽。咳嗽，咳痰黄稠，胸隔痞闷，甚则气急呕恶，舌质红，苔黄腻，脉滑数（B对）。二陈汤主治湿痰犯肺咳嗽（A错）。贝母瓜萎散主治肺燥有痰咳嗽（C错）。苓甘五味姜辛汤主治寒痰内蕴咳嗽（D错）。止嗽散主治风邪犯肺咳嗽（E错）。